资源严重减少的野生药材是
A. 豹骨
B. 熊胆
C. 两者均是
D. 两者均不是

正确答案：D。两者均不是

解析：本题考查三级保护野生药材物种。三级保护野生药材物种系指资源严重减少的主要常用野生药材物种。属于三级保护野生药材物种的有：川贝母（4个品种）、伊贝母（2个品种）、刺五加、黄芩、天冬、猪苓、龙胆（4个品种）、防风、远志（2个品种）、胡黄连、肉苁蓉、秦艽（4个品种）、细辛（3个品种）、紫草、五味子（2个品种）、蔓荆子（2个品种）、诃子（2个品种）、山茱萸、石斛（5个品种）、阿魏（2个品种）、连翘（2个品种）、羌活（2个品种）。豹骨和熊胆均不在此列，因此两者均不是（D对）资源严重减少的主要常用野生药材。